有关胰血管的描述，哪句不正确？
A. 胰十二指肠上动脉来自肠系膜下动脉
B. 胰十二指肠下动脉也营养胰头
C. 胰十二指肠上动脉营养胰头
D. 胰十二指肠下动脉也来自肠系膜上动脉
E. 胰体胰尾由脾动脉分出的动脉营养

正确答案：A。胰十二指肠上动脉来自肠系膜下动脉

解析：胰十二指肠上动脉来自胃十二指肠动脉（A错，为本题正确答案）。胰十二指肠上、下动脉（BC对）营养胰头。胰十二指肠下动脉也来自肠系膜上动脉（D对）。胰体胰尾由脾动脉分出的动脉营养（E对）。